治疗久咳虚喘之证，宜选用的药物是
A. 桑白皮
B. 葶苈子
C. 白果
D. 莱菔子
E. 马兜铃

正确答案：C。白果

解析：白果的应用于哮喘痰嗽，本品性涩而收，能敛肺定喘，且兼有一定的化痰之功，治疗久咳虚喘之证。如肺肾两虚之虚喘，配五味子、胡桃肉等以补肾纳气，敛肺平喘 （C对）。桑白皮的应用于肺热咳喘，水肿的功效（A错）。葶苈子的应用于痰涎雍盛，喘息不得平卧，水肿，悬饮，胸腹积水，小便不利的功效（B错）。莱菔子的应用于食积气滞，咳喘痰多，胸闷食少的功效（D错）。马兜铃的应用于肺热咳喘，痔疮肿痛或出血的功效（E错）。